《中华人民共和国广告法》规定，广告监督管理机关是
A. 县级以上药品监督管理部门
B. 县级以上工商行政管理部门
C. 县级以上质量技术监督部门
D. 广告经营者上级主管部门
E. 广告发布者上级主管部门

正确答案：B。县级以上工商行政管理部门